下列哪项不是健康促进的活动领域
A. 创造支持的环境
B. 加强社区的行动
C. 发展个人技能
D. 提供健康信息
E. 调整卫生服务方向

正确答案：D。提供健康信息